根据现行法律法规和国务院办公厅“三定方案”，负责建立国家基本药物制度，制定国家药物政策的政府部门是
A. 卫生健康部门
B. 中医药管理部门
C. 医疗保障部门
D. 工业和信息化部门
E. 公安部门

正确答案：A。卫生健康部门

解析：本题考查药品管理工作相关部门。卫生健康部门（A对）根据现行法律法规和国务院办公厅“三定方案”，负责建立国家基本药物制度，制定国家药物政策。